日本发生的水俣病是由于
A. 铅中毒
B. 苯中毒
C. 锰中毒
D. CO中毒
E. 汞中毒

正确答案：E。汞中毒

解析：水俣病是因食入被有机汞污染河水中的鱼、贝类所引起的甲基汞为主的有机汞中毒（E对），是有机汞侵入脑神经细胞而引起的一种综合性疾病。